患儿，3岁。形体明显消瘦，肚腹膨胀，面色萎黄无华，发结如穗，夜卧不宁，食欲减退，多食多便。其治法是
A. 消食导滞
B. 和脾助运
C. 导滞通下
D. 理气和胃
E. 消积理脾

正确答案：E。消积理脾

解析：患儿以形体明显消瘦、面色萎黄无华、发结如穗、夜卧不宁、食欲减退为特征，当属疳证。其初起为疳气阶段。继之脾胃虚损，运化不及，积滞内停，壅塞气机，阻滞络脉，则呈现虚中夹实的疳积，应消积与健脾并行（E对）。消食导滞适于饮食内停证（A错）。和脾助运只助脾运，未消食积（B错）。导滞通下适于饮食内停所致腹胀、便秘等症（C错）。理气和胃适于脾胃气滞证，未行消积之力（D错）。